中华人民共和国卫生部颁布的《医务人员医德规范及实施办法》这一文献的基本精神是
A. 对病人一视同仁
B. 文明礼貌服务
C. 廉洁行医
D. 为病人保守医密
E. 实行社会主义人道主义

正确答案：E。实行社会主义人道主义